依据《医疗机构药品监督管理办法（试行）》，医疗机构应当向所在地药品监督管理部门提交药品质量管理年度自查报告，其报告内容不包括
A. 药品质量管理制度的执行情况
B. 医疗机构制剂配制变化情况
C. 临床药师参与临床药物治疗执行情况
D. 接受药品监督管理部门的监督检查及整改落实情况
E. 对药品监督管理部门的意见和建议

正确答案：C。临床药师参与临床药物治疗执行情况

解析：本题考查医疗机构年度自查报告内容。依据《医疗机构药品监督管理办法（试行）》，医疗机构应当向所在地药品监督管理部门提交药品质量管理年度自查报告，其报告内容不包括临床药师参与临床药物治疗执行情况（C错，为本题正确答案）。《医疗机构药品监督管理办法（试行）》第一章总则第五条：医疗机构应当向所在地药品监督管理部门提交药品质量管理年度自查报告，自查报告应当包括以下内容：（一）药品质量管理制度的执行情况（A对）；（二）医疗机构制剂配制的变化情况（B对）；（三）接受药品监督管理部门的监督检查及整改落实情况（D对）；（四）对药品监督管理部门的意见和建议（E对）。